“太仓”所指的是
A. 三焦
B. 胃
C. 小肠
D. 脾
E. 大肠

正确答案：B。胃

解析：该题考查脏腑的别称，属于基本知识。三焦有“孤府”、“决渎之官”之称（A错）。胃有“太仓”、“水谷之海”之称（B对）。小肠有“受盛之官”之称（C错）。脾有“仓廪之官”之称，与胃之“太仓”不可混淆（D错）。大肠有“传导之官”之称（E错）。